测定缓、控释制剂的体外释放度时，至少应测
A. 1个取样点
B. 2个取样点
C. 3个取样点
D. 4个取样点
E. 5个取样点

正确答案：C。3个取样点